某女，5岁。因热毒内蕴、毒邪未尽导致口疮肿痛、烦躁口渴、大便秘结，医师给其处以小儿化毒散。患儿家长长依方购药，按说明服用数日，口疮愈。因小儿化毒散除清热解毒外，又能
A. 敛疮生肌
B. 活血消肿
C. 消肿散结
D. 拔毒消肿
E. 祛腐生肌

正确答案：B。活血消肿

解析：本题考查的是小儿化毒散的功能。小儿化毒散除清热解毒外，又能活血消肿（B对）。小儿化毒散：【功能】清热解毒，活血消肿。生肌玉红膏：【功能】解毒，祛腐，生肌。生肌玉红膏，清解与收敛同用，既清解热毒，又祛腐、敛疮生肌（A错）。阳和解凝膏：【功能】温阳化湿，消肿散结（C错）。拔毒消肿（D错）为拔毒消肿敛疮药的功效。拔毒消肿敛疮药指凡以拔毒化腐、消肿敛疮为主要功效的药物。京万红软膏：【功能】活血解毒，消肿止痛，去腐生肌（E错）。